因含有朱砂，如过量服用，可致急性肾功能衰竭的中成药是
A. 牛黄上清丸
B. 天王补心丸
C. 牛黄降压丸
D. 冠心苏合丸
E. 牛黄解毒丸

正确答案：B。天王补心丸

解析：本题考查的是包含毒性中药的中成药。因含有朱砂，如过量服用，可致急性肾功能衰竭的中成药是天王补心丸（B对）。含朱砂、轻粉、红粉的中成药：（一）含朱砂、轻粉、红粉的中成药：牛黄清心丸、牛黄抱龙丸、抱龙丸、朱砂安神丸、天王补心丸、安神补脑丸、苏合香丸、人参再造丸、安宫牛黄丸、牛黄千金散、牛黄镇惊丸、紫雪散、梅花点舌丸、紫金锭（散）、磁朱丸、更衣丸、复方芦荟胶囊。（一）中毒机制：此类药物含汞，属汞中毒。机体吸收后迅速弥散到各个器官和组织，并可通过血-脑屏障进入脑组织，产生各种中毒症状。（二）中毒表现 ：1.消化系统表现为恶心呕吐、腹痛腹泻、口中有金属味、流涎、口腔黏膜充血、牙龈肿胀溃烂等。2.泌尿系统表现为少尿、蛋白尿，严重者可发生急性肾功能衰竭。3.神经系统及精神方面症状。牛黄上清丸（A错）为妊娠慎用中成药。牛黄降压丸（C错）不能与含麻黄的中成药并用。冠心苏和丸（D错）含冰片，为妊娠禁用中成药。牛黄解毒丸（E错）含雄黄。雄黄及含雄黄的中成药：（一）含雄黄的中成药：牛黄解毒丸（片）、六神丸、喉症丸、安宫牛黄丸、牛黄清心丸、牛黄镇惊丸、牛黄抱龙丸、牛黄至宝丸、追风丸、牛黄醒消丸、紫金锭（散）、三品等。（一）中毒机制：雄黄主要成分含二硫化二砷，此外还含有少量三氧化二砷。砷盐毒性较大，进入体内后，蓄积和分布于体内各组织，主要分布在肝、肾、脾等内脏及指甲、毛发等部位。砷对机体的毒性作用是多方面的，首先危害神经细胞，使中枢神经中毒，产生一系列中毒症状，并直接影响毛细血管通透性。也可使血管舒缩中枢麻痹，而导致毛细血管扩张，并可引起肝、肾、脾、心脏等血管的脂肪变性和坏死。（二）中毒表现 ：1.消化系统表现为口腔咽喉干痛、烧灼感，口中有金属味，流涎，剧烈恶心呕吐、腹痛腹泻，严重时类似霍乱。2.各种出血症状，如吐血、咯血、眼结膜充血、鼻衄、便血、尿血等。3.肝肾功能损害而引起转氨酶升高、黄疸、血尿、蛋白尿等。4.严重者因心力衰竭、呼吸衰竭而死亡。5.长期接触可引起皮肤过敏，出现丘疹、疱疹、痤疮样皮疹等。